中药材生产关系到中药的质量和临床疗效。关于中药材种植和产地初加工管理的说法，错误的是
A. 禁止在非适宜区种植、养殖中药材
B. 中药材初加工严禁滥用硫黄熏蒸
C. 对野生或半野生药用动植物的采集应坚持“最大持续产量”原则
D. 对道地药材采收加工应选用现代化、产业化方法

正确答案：D。对道地药材采收加工应选用现代化、产业化方法

解析：本题考查的是中药材产地初加工管理。地道药材加工时，应按传统方法进行加工（D错，为本题正确答案）。中药材产地初加工管理：中药材产地初加工是指在产地对地产中药材进行洁净、除去非药用部位、干燥等处理，是防止霉变虫蛀、便于储存运输、保障中药材质量的重要手段。采集、贮存中药材以及对中药材进行初加工，应当符合国家有关技术规范、标准和管理规定。各地要结合地产中药材的特点，加强对中药材产地初加工的管理，逐步实现初加工集中化、规范化、产业化。地产中药材应当逐品种制定产地初加工规范，统一质量控制标准，改进加工工艺，提高中药材产地初加工水平，避免粗制滥造导致中药材有效成分流失、质量下降。严禁滥用硫黄熏蒸等方法（B对），二氧化硫等物质残留必须符合国家规定。严厉打击产地初加工过程中掺杂使假、染色增重、污染霉变、非法提取等违法违规行为。采集应坚持“最大持续产量”原则，野生或半野生药用动植物的采集应坚持“最大持续产量”原则（C对），“最大持续产量”即不危害生态环境，可持续生产（采收）的最大产量。确定适宜的采收时间和方法，有计划地进行野生抚育、轮采与封育，以利生物的繁衍与资源的更新。根据产品质量及植物单位面积产量或动物养殖数量，并参考传统采收经验等因素确定适宜的采收时间，包括采收期、采收年限，以及采收方法。对采收机械、器具、加工场地的要求，采收机械、器具应保持清洁、无污染，存放在无虫鼠害和禽畜的干燥场所。加工场地应清洁、通风，具有遮阳、防雨和防鼠、虫及禽畜的设施。对药用部分采收后的要求，药用部分采收后，经过拣选、清洗、切制或修整等适宜的加工，需干燥的应采用适宜的方法和技术迅速干燥，并控制温度和湿度，使中药材不受污染，有效成分不被破坏。鲜用药材可采用冷藏、砂藏、罐贮、生物保鲜等适宜的保鲜方法，尽可能不使用保鲜剂和防腐剂。如必须使用时，应符合国家对食品添加剂的有关规定。采收及初加工过程中应尽可能排除非药用部分及异物，特别是杂草及有毒物质，剔除破损、腐烂变质的部分。地道药材加工时，应按传统方法进行加工。如有改动，应提供充分试验数据，不得影响药材质量。药品生产企业销售中药材，必须标明产地。发运中药材必须有包装。在每件包装上，必须注明品名、产地、日期、调出单位，并附有质量合格的标志。